患者有足下垂和足背皮肤感觉缺失，损伤可能涉及
A. 闭孔神经
B. 腓深神经
C. 股神经
D. 腓总神经
E. 胫神经和腓浅神经

正确答案：D。腓总神经

解析：损伤闭孔神经（A错）导致大腿内侧1/3皮肤感觉缺失，内收肌群麻痹，是患侧不能内收。腓深神经（B错）损伤导致小腿前群肌瘫痪、足背肌及第1、2趾相对缘的皮肤感觉丧失。股神经（C错）损伤导致屈髋无力，坐位时不能伸膝，行走困难，膝跳反射消失，大腿前面和小腿内侧面皮肤感觉障碍。腓总神经（D对）受伤后由于小腿前、外侧群肌功能丧失，表现为足不能背屈，趾不能伸，足下垂且内翻，呈“马蹄内翻足”畸形,行走时呈“跨阈步态”。胫神经损伤后由于小腿后群肌收缩无力，主要表现为足不能拓屈，不能以足尖站立，内翻力减弱，腓浅神经损伤后导致腓骨长肌和腓骨短肌瘫痪，小腿外侧、足背和第2-5趾背的皮肤感觉丧失（E错）。